急性牙髓炎的早期可以称为
A. 急性浆液性牙髓炎
B. 急性化脓性牙髓炎
C. 急性增生性牙髓炎
D. 急性浆液性根尖周炎
E. 急性牙周脓肿

正确答案：A。急性浆液性牙髓炎

解析：急性牙髓炎的早期病变局限在受刺激部位相对应的牙髓，如龋损下方，可以称为急性浆液性牙髓炎。掌握“急、慢性牙髓炎”知识点。